心理咨询有4个基本过程，应除外
A. 技术手段准备阶段
B. 问题探索阶段
C. 分析认识阶段
D. 治疗行动阶段
E. 结束巩固阶段

正确答案：A。技术手段准备阶段